男，55岁。上腹疼痛伴反酸、烧心15年，近期出现体重下降。最有价值的检查是
A. 胃肠道造影检查
B. CT检查
C. 超声检查
D. 血清学检测
E. 胃镜

正确答案：E。胃镜

解析：中老年男性患者，有15年上腹痛病史伴反酸、烧心（明显消化系统症状），近期体重下降，提示有恶病质表现。患者考虑慢性胃部疾病进展为胃癌，为明确诊断，应首选胃镜检查（E对）。胃镜不仅可以直接观察胃黏膜病变，还可以获取病变组织做病理学检查。胃肠道造影检查（A错）可发现胃内溃疡（呈龛影）及隆起的病灶（呈充盈缺损），但难以鉴别其良恶性（P366），故不能用于确诊胃癌。CT检查（B错）对评价胃癌的病变范围、局部淋巴结转移和远处转移等方面具有较高的价值，可用于胃癌术前临床分期，但在确诊胃癌方面不如胃镜结合活检可靠。超声检查（C错）容易受到胃内气体干扰，不用于诊断胃部疾病。血清学检测（D错）可查肿瘤标志物、胃蛋白酶原、幽门螺杆菌抗体等，可作为胃癌的筛查方法，其价值低于胃镜检查。